单纯疱疹病毒直径约为
A. 50nm
B. 100nm
C. 120nm
D. 150nm
E. 200nm

正确答案：C。120nm

解析：本题考查掌握口腔单纯疱疹。单纯疱疹病毒直径约为120nm（C对）。单纯疱疹病毒是有包膜的DNA病毒。病毒呈球形，病毒核衣壳为由162个壳微粒组成的立体对称20面体，直径约为120~ 150nm。（做题技巧：对于涉及范围的试题，优选小数值）。